阿哌沙班属于
A. 凝血因子X抑制剂
B. 维生素K拮抗剂
C. 直接凝血酶抑制剂
D. 环氧酶抑制剂
E. 整合素受体阻断剂

正确答案：A。凝血因子X抑制剂

解析：本题考查药物的分类 。凝血因子X抑制剂（A对）主要有阿哌沙班和利伐沙班。维生素K拮抗剂（B错）有华法林。直接凝血酶抑制剂（C错）有达加比群酯。环氧酶抑制剂（D错）代表药为阿司匹林。整合素受体阻断剂（E错）代表药物有替罗非班。